女性，30岁，停经43天，阴道少量出血伴下腹隐痛2天。行吸宫术，病理报告为“蜕膜组织”。首先应考虑的疾病是
A. 闭经
B. 先兆流产
C. 月经
D. 月经不调
E. 异位妊娠

正确答案：E。异位妊娠

解析：育龄期女性，停经43天，阴道少量流血伴下腹痛（典型症状为停经后腹痛与阴道流血），行吸宫术，病理报告为“蜕膜组织”（蜕膜为受精卵着床后的子宫内膜，刮宫仅见蜕膜未见绒毛提示异位妊娠），首先应考虑的疾病是异位妊娠（E对）。闭经（P352）（A错）表现为无月经或月经停止，不会出现阴道流血以及蜕膜组织。先兆流产（P48）（B错）腹痛性质为阵发性下腹痛或腰背痛，行吸宫术病理检查可见到绒毛及蜕膜组织。月经（C错）、月经不调（D错）行吸宫术病理检查均不会见“蜕膜组织”。